目前我国法定报告的传染病的数量是
A. 37种
B. 39种
C. 24种
D. 25种
E. 20种

正确答案：B。39种

解析：本题考查目前我国法定报告的传染病的数量。目前我国法定报告的传染病的数量是3类39种（B对ACDE错），其中甲类2种、乙类26种、丙类11种。